生物利用度除了可以表示进入全身循环药物量的多少外，还可以表示
A. 用药剂量
B. 体内药物总量
C. 半数有效剂量
D. 生物利用度
E. 药物进入全身循环的速度

正确答案：E。药物进入全身循环的速度

解析：除了以进入全身循环药物量的多少来表示生物利用度外，生物利用度还有另外一个含义，即药物进入全身循环的速度。掌握“药物消除及重要参数”知识点。